流行性出血热的传染源主要是
A. 家畜
B. 患者
C. 蚊虫
D. 毛蚶
E. 鼠类

正确答案：E。鼠类

解析：鼠类为流行性出血热主要传染源（E对），其他还有猫、狗、猪和免等，我国以黑线姬鼠和褐家鼠为主，林区以大林姬鼠为主。虽然早期患者的血液和尿液中携带病毒，但人不是主要传染源。